心肌细胞内Ca2+达到何种数值才达到心肌收缩的阈值
A. 10-8mol/L
B. 10-7mol/L
C. 10-6mol/L
D. 10-5mol/L
E. 10-4mol/L

正确答案：D。10-5mol/L

解析：心肌兴奋-收缩耦联的关键是Ca2+与肌钙蛋白的结合，只有当心肌细胞内Ca2+浓度达到10-5mol/L（D对）时，才能启动兴奋-收缩耦联过程。